可用于晚期癌症止痛的药物
A. 苯巴比妥
B. 安定
C. 吗啡
D. 苯妥英钠
E. 氯丙嗪

正确答案：C。吗啡

解析：本题考查镇痛药。强阿片类药如吗啡（C对）可用于术后止痛以及中到重度癌性疼痛；苯巴比妥（A错）用于镇静、催眠、抗癫痫、抗惊厥；安定（B错）即地西泮，用于镇静催眠、抗焦虑；苯妥英钠（D错）可用于癫痫大发作、洋地黄中毒所致的室性及室上性心律失常等；氯丙嗪（E错）可用于精神分裂。